视网膜后部被称为“生理盲点”是
A. 视神经盘
B. 视盘陷凹
C. 黄斑
D. 黄斑区的中央凹
E. 黄斑外侧的部分

正确答案：A。视神经盘

解析：视神经盘（A对）的视盘凹陷（B错）无感光细胞，且视网膜中央动、静脉穿过，被称为生理性盲点。黄斑（C错）的中央凹（D错）由密集的视锥细胞构成，且无血管走行，是视网膜感光最敏锐的部分。